脓液呈淡黄或淡红稀薄时常提示感染病原菌为
A. 金黄色葡萄球菌
B. 链球菌
C. 铜绿假单胞菌
D. 结核菌
E. 混合性细菌感染

正确答案：B。链球菌

解析：本题考查脓液呈淡黄或淡红稀薄时常提示的感染病原菌。脓液呈淡黄或淡红稀薄时常提示感染病原菌为链球菌（B对）。当急性炎症局限为脓肿后，由于主要感染菌种的不同，其脓液性状也有差异，例如，金黄色葡萄球菌（A错）为黄色黏稠脓液；链球菌一般为淡黄或淡红稀薄脓液，有时由于溶血而呈褐色；铜绿假单胞菌（C错）的典型脓液为翠绿色，稍黏稠，有酸臭味；混合性细菌感染（E错）则为灰白或灰褐色脓液，有明显的腐败坏死臭味。结核菌（D错）感染者痰中带血。